宫血宁胶囊药简多能，善治血热崩漏等，其除能凉血止血外，又能
A. 疏肝解郁，化瘀止痛
B. 疏肝解郁，理气止痛
C. 清热除湿，化瘀止痛
D. 清热解毒，燥湿止带
E. 清热除湿，理气止痛

正确答案：C。清热除湿，化瘀止痛

解析：本题考查的是宫血宁胶囊的功能。宫血宁胶囊药简多能，善治血热崩漏等，其除能凉血止血外，又能清热除湿，化瘀止痛（C对）。宫血宁胶囊：【功能】凉血止血，清热除湿，化瘀止痛。妇炎平胶囊：【功能】清热解毒，燥湿止带（D错），杀虫止痒。功能为疏肝解郁，化瘀止痛（A错）、疏肝解郁，理气止痛（B错）或清热除湿，理气止痛（E错）的中成药，2022年考试指南未明确说明。